确定涎腺占位性病变首选的检查方法为
A. 涎腺平片
B. 涎腺造影术
C. B超
D. CT
E. 磁共振成像（MRI）

正确答案：C。B超

解析：本题考查唾液腺肿瘤的影像学诊断。确定涎腺占位性病变首选的检查方法为B超（C对）。腮腺肿瘤禁忌做活检，因为无论是良、恶性肿瘤，均有发生细胞种植的危险，影像学检查有助于术前诊断。B超可以确定涎腺占位性病变以及肿瘤的大小，并估计大致的性质，简捷价廉，可重复而无损伤，当临床上腮腺良性肥大、腮腺炎症肿块与肿瘤难以区分时，首选B超检查。涎腺平片（A错）适用于涎腺导管内结石的检查，也可用来检查涎腺肿瘤对下颌骨造成的损害。涎腺造影术（B错）对于涎腺炎症及舍格伦综合征的诊断价值很高。CT（D错）检查对肿瘤的定位十分有益，可确定肿瘤的部位以及与周围组织的关系，特别适用于腮腺深叶肿瘤。磁共振成像（MRI）（E错）适用于肿瘤范围广泛，侵犯多个组织器官的病例，在显示肿瘤与颈鞘的关系方面优于CT。